对LD₅₀描述错误的是
A. 指毒物引起一半受试对象死亡所需要的剂量
B. 是评价毒物急性毒性大小最重要的参数
C. 是对不同毒物进行急性毒性分级的基础标准
D. 毒物的急性毒性与LD₅₀呈正比

正确答案：D。毒物的急性毒性与LD₅₀呈正比

解析：本题考查LD₅₀的相关内容。LD₅₀即半数致死剂量，指毒物引起一半受试对象死亡所需要的剂量（A对）。它是评价毒物急性毒性大小最重要的参数（B对），是对不同毒物进行急性毒性分级的基础标准（C对）。毒物的急性毒性与LD₅₀呈反比（D错，为本题正确答案），LD₅₀数值越小，表示外源化学物的毒性越强；LD₅₀数值越大，毒性越低。